“限定日剂量”的英文缩写是
A. DDD
B. DUI
C. DBI
D. DOCA
E. DMPA

正确答案：A。DDD